合理用药的基本要素包括
A. 安全性
B. 经济性
C. 有效性
D. 适当性
E. 方便性

正确答案：A、B、C、E。安全性；经济性；有效性；方便性